鉴别室速与阵发性室上速最有力的证据是
A. QRS波群宽大畸形的程度
B. 是否存在房室分离
C. 心室率的快慢
D. 静脉应用普罗帕酮是否可终止
E. 对迷走神经刺激的反应

正确答案：B。是否存在房室分离

解析：室速与阵发性室上速伴有室内差异性传导的心电图表现十分相似。但室速常存在房室分离（B对），房室分离是指心脏出现两个激动点，心房的激动点控制心房，心室的激动点控制心室，心房独立活动与QRS波无固定关系。此时由于一些提早出现的QRS波群没有P波出现，因此室率＞房率。多见于三度房室传导阻滞、心房颤动、室速等。QRS波群的形态也可作为室速和室上速的鉴别点，但不是主要鉴别依据：室速QRS波群宽大畸形，时限多≥0.14s，而85%的室上速QRS波群时限常＜0.14s（A错）。室速（P198）的心室率通常为100～250次/分，而阵发性室上速（P192）的心室率多为150～250次/分，故心室率的快慢（C错）不是鉴别室速与阵发性室上速最有力的证据。普罗帕酮（P206）为广谱抗心律失常药物，可用于室速和室上性心动过速的治疗，静脉应用普罗帕酮可能对两者都有效果（D错）。刺激迷走神经（包括按压颈动脉窦），不影响室速心室率，但可使心房率减慢从而显示房室分离，可能对室上速心率无影响，也可能使室上速突然转复为窦性心律，对鉴别室速与阵发性室上速意义不大（E错）。